通常不适用于慢性非传染性疾病的是
A. 关联强度
B. 生物学合理性
C. 结果的一致性
D. 实验证据
E. 特异性

正确答案：E。特异性

解析：本题考查希尔准则的特异性。特异性指病因和疾病之间的排他性或特异程度。如果一种病因只能引起一种疾病，或只在某特殊人群引起疾病，且该疾病只有一种病因，该病因与疾病的关系具有高度特异性。因此，特异性（E对ABCD错）通常不适用慢性非传染性疾病。